胡黄连的功效是
A. 解暑截疟
B. 清肺生津
C. 利尿通淋
D. 清除湿热
E. 收敛止血

正确答案：D。清除湿热

解析：本题考查的是胡黄连的功效。胡黄连的功效是清除湿热（D对）。胡黄连：【功效】退虚热，除疳热，清湿热，解热毒。【功效】退虚热，凉血，解暑，截疟（A错）。地骨皮：【功效】退虚热，凉血，清肺降火，生津（B错）。白薇：【功效】退虚热，凉血清热，利尿通淋（C错），解毒疗疮。石膏：【功效】生用：清热泻火，除烦止渴；煅用：收湿敛疮，生肌止血（E错）。